维生素D缺乏性佝偻病激期血生化的特点是
A. 血清钙正常，血清磷降低，碱性磷酸酶降低
B. 血清钙降低，血清磷降低，碱性磷酸酶增高
C. 血清钙降低，血清磷正常，碱性磷酸酶增高
D. 血清钙降低，血清磷增高，碱性磷酸酶降低
E. 血清钙正常，血清磷降低，碱性磷酸酶增高

正确答案：B。血清钙降低，血清磷降低，碱性磷酸酶增高

解析：维生素D缺乏性佝偻病活动期（激期）血钙稍降低，血磷明显降低，AKP明显升高（B对）。